外源化学物通过生物膜的方式中需要消耗能量的是
A. 膜动转运
B. 易化扩散
C. 简单扩散
D. 滤过

正确答案：A。膜动转运

解析：本题考查外源化学物通过生物膜的方式。外源化学物通过生物膜的方式有被动转运、特殊转运和膜动转运等。其中膜动转运（A对BCD错）是细胞与外界环境交换大分子物质的过程，主要特点是生物膜结构发生变化，转运过程具有特异性、主动选择性、消耗一定能量的特点。